男，22岁。反复发作，上腹部疼痛6个月。胃镜检查见十二指肠球部溃疡。该患者没有出现的生理变化是
A. 迷走神经功能亢进
B. 促胃液素水平升高
C. 内因子分泌减少
D. 胃蛋白酶分泌增加
E. 胃酸分泌增加

正确答案：C。内因子分泌减少

解析：青壮年男性患者，诊断为十二指肠球部溃疡。内因子分泌减少（C错，为本题正确答案）多见于慢性萎缩性A型胃炎。胃蛋白酶（D对）、胃酸（E对）分泌增加致侵袭作用增强，可引发十二指肠球部溃疡。迷走神经功能亢进（A对）、促胃液素水平升高（B对）可使胃酸水平升高，间接导致十二指肠球部溃疡。